痰停经络，则
A. 恶心呕吐
B. 神志昏糊
C. 肢体麻木
D. 痰核瘰疬
E. 咳嗽气喘

正确答案：C。肢体麻木

解析：痰饮可以阻滞气机，如流注经络，则经络阻滞，气血运行不畅，出现肢体麻木、屈伸不利，甚至半身不遂（C对）。恶心呕吐（A错）是由于痰饮停于胃，胃失和降所致。神志昏糊（B错）是痰浊上犯，与风、火相合，蒙蔽心窍，扰乱神明所出现的。痰核瘰疬（D错）是痰饮结于局部形成的。咳嗽气喘（E错）是痰饮阻滞，肺失宣降所致。